气性坏疽治疗应首选
A. 中医治疗
B. 抗生素治疗
C. 病变区先作广泛多处切开，后用氧化剂冲洗
D. 全身支持治疗
E. 截除患肢

正确答案：C。病变区先作广泛多处切开，后用氧化剂冲洗

解析：早期急症清创是处理气性坏疽的关键。截肢的部位应在肿胀的界面以上，通过健康组织进行，残端不做缝合，用氧化剂冲洗、湿敷，经常更换敷料，必要时还要再次清创，对疑有气性坏疽的伤口，可用3%过氧化氢或1:1000高锰酸钾等溶液冲洗、湿敷（C对）。一旦确诊，应采取中西医结合方法积极抢救治疗。包括紧急手术清创，广泛切口引流，应用足量抗生素，尽早采用高压氧治疗，加强支持疗法。中医以清热解毒为大法（A错）。首选青霉素，常见梭状芽孢杆菌对青霉素敏感，但剂量需大，每天用量应在1000万U以上。大环内酯类（如琥乙红霉素、麦迪霉素等）和硝唑类（如甲硝唑、替硝唑等）抗生素也有一定疗效。氨基糖苷类抗生素（如卡那霉素、庆大霉素等）对此类细菌已证实无效（B错）。全身支持疗法，包括输血、纠正水与电解质失调、营养支持，积极进行止痛、镇静、退热等对症处理（D错）。如果整个肢体已广泛感染，应果断进行截肢以挽救生命（E错）。